狭义的文化是指
A. 精神文化
B. 主文化
C. 物质文化
D. 物质财富
E. 反文化

正确答案：A。精神文化

解析：本题考查狭义的文化。狭义的文化特指精神文化（A对BCDE错），指人类一切精神财富的总和，包括思想意识、宗教信仰、文学艺术、道德规范、法律、习俗、教育、科学技术和知识等。